除另有规定外，要求检查释放度的剂型是
A. 橡胶贴膏
B. 凝胶贴膏
C. 膏药
D. 透皮贴剂
E. 软膏剂

正确答案：D。透皮贴剂

解析：本题考查的是贴剂质量要求。除另有规定外，要求检查释放度的剂型是透皮贴剂（D对）。透皮贴剂指用于完整皮肤表面，能将药物透过皮肤进入血液循环系统的起全身作用贴剂。贴剂的含量均匀度、释放度、微生物限度等照《中国药典》规定的检查方法检查，应符合规定。橡胶贴膏（A错）系指原料药物与橡胶等基质混匀后涂布于背衬材料上制成的贴膏剂。橡胶贴膏的含膏量、耐热性、黏着力等均应符合相关规定。橡胶贴膏每10cm²不得检出金黄色葡萄球菌和铜绿假单胞菌。凝胶贴膏（B错）系指原料药物与适宜的亲水性基质混匀后涂布于背衬材料上制成的贴膏剂。凝胶贴膏的含膏量、赋型性、黏着力、含量均匀度、微生物限度等均应符合规定。膏药（C错）：系指饮片、食用植物油与红丹（铅丹）或官粉（铅粉）炼制成膏料，摊涂于裱褙材料上制成供皮肤贴敷的外用制剂。除另有规外，膏药应密闭，置阴凉处贮存。软化点、重量差异等应符合《中国药典》规定。软膏剂（E错）系指原料药物与油脂性或水溶性基质混合制成的均匀的半固体外用制剂。软膏剂应均匀、细腻，具有适当的黏稠性，易涂布于皮肤或黏膜上并无刺激性；应无酸败、变色、变硬、融化、油水分离等变质现象。除另有规定外，混悬型软膏剂、含饮片细粉的软膏剂照《中国药典》粒度和粒度分布法测定，均不得检出大于180μm的粒子。用于烧伤或严重创伤的软膏剂应进行无菌检查。软膏剂的装量、微生物限度等应符合规定。